内基氏小体是
A. 狂犬病病毒包涵体
B. 麻疹病毒包涵体
C. 腺病毒包涵体
D. 疱疹病毒包涵体
E. 衣原体包涵体

正确答案：A。狂犬病病毒包涵体

解析：内基氏（Negri）小体，为诊断动物狂犬病的指征。掌握“狂犬病、人乳头瘤病毒”知识点。